上3尖牙麻醉引起
A. 翼下颌间隙感染
B. 眶下间隙感染
C. 下颌下间隙感染
D. 暂时性面瘫
E. 暂时性牙关紧闭

正确答案：B。眶下间隙感染

解析：本题考查口腔颌面部间隙感染。上3尖牙麻醉引起眶下间隙感染（B对）。眶下间隙：【感染来源】多来自上颌尖牙、第一前磨牙和上颌切牙的根尖化脓性炎症和牙槽脓肿；此外，可因上颌骨骨髓炎的脓液穿破骨膜，或上唇底部与鼻侧的化脓性炎症扩散至眶下间隙引起。翼下颌间隙（A错）：【感染来源】常见为下颌智齿冠周炎及下颌磨牙根尖周炎症扩散所致；下牙槽神经阻滞麻醉时消毒不严或拔下颌第三磨牙时创伤过大，也可引起翼下颌间隙感染；此外，相邻间隙，如颞下间隙、咽旁间隙炎症也可波及。下颌下间隙（C错）：【感染来源】多见于下颌智齿冠周炎、下颌后牙根尖周炎、牙槽脓肿等牙源性感染或下颌下淋巴结炎的扩散。化脓性下颌下腺炎有时亦可继发下颌下间隙感染。暂时性面瘫（D错）：为局麻的并发症，常因将麻药注射入腮腺内。暂时性牙关紧闭（E错）：为局麻的并发症，常因将麻药注射入咬肌或翼内肌。